免疫球蛋白的功能区含有VH、CH1、CH2和CH3四个功能区的是
A. VL和C1
B. IgM和IgE
C. IgG、IgD的重链
D. IgM、IgG、IgD的重链
E. IgA、IgG、IgD的重链

正确答案：E。IgA、IgG、IgD的重链

解析：免疫球蛋白的功能区：Ig通过折叠可形成若干球形结构域，这些结构域是Ig的功能区。轻链有VL和C1两个功能区；IgA、IgG、IgD的重链有VH、CH1、CH2和CH3四个功能区；IgM和IgE重链多一个CH4功能区。掌握“免疫球蛋白基本概念及结构”知识点。